汽车司机小张今日患过过敏性鼻炎，适合工作性质的H₁受体拮抗剂有
A. 盐酸苯海拉明
B. 盐酸西替利嗪
C. 盐酸赛庚啶
D. 马来酸氯苯那敏
E. 地氯雷他定

正确答案：B、E。盐酸西替利嗪；地氯雷他定

解析：本题考查H₁受体拮抗剂的不良反应。第二代H₁受体拮抗药（如地氯雷他定（E对）、盐酸西替利嗪（B对）等）因难以透过血脑屏障，没有中枢镇静作用。第一代H₁受体拮抗药（如盐酸苯海拉明（A错）、盐酸赛庚啶（C错）、马来酸氯苯那敏（D错）、异丙嗪等）多有明显的中枢镇静作用，成为抗过敏治疗时的主要副作用。